正确描述内侧丘系的是
A. 主要纤维来自同侧的薄束核和楔束核
B. 终于对侧丘脑腹后核
C. 在延髓中央管背侧交叉后形成
D. 是传递对侧本体觉和精细触觉冲动的纤维
E. 以上都不对

正确答案：D。是传递对侧本体觉和精细触觉冲动的纤维

解析：内侧丘系是躯干和四肢意识性本体感觉和精细触觉传导通路中的纤维之一。主要纤维来自对侧的薄束核和楔束核（A错），在薄、楔束核内，由此2核发出的纤维向前绕过中央灰质的腹侧，在中线上与对侧的交叉，称内侧丘系交叉（C错），交叉后的纤维转折向上，在锥体束的背侧呈前后方向排列，行于延髓中线两侧，称内侧丘系，终于同侧丘脑腹后核（B错），是传递对侧本体觉和精细触觉冲动的纤维（D对）。